在我国实施人类辅助生殖技术，下列各项中违背卫生部制定的原则的是
A. 使用捐赠的精子
B. 使用捐赠的卵子
C. 实施亲属代孕
D. 实施卵胞浆内单精注射
E. 使用捐赠的胚胎

正确答案：C。实施亲属代孕

解析：《人类辅助生殖技术管理办法》第三条规定，医疗机构和医务人员不得实施亲属代孕（C错，为本题正确答案）。使用捐赠的精子（A对）、使用捐赠的卵子（B对），实施卵胞浆内单精注射（D对），使用捐赠的胚胎（E对）都是人类辅助生殖技术的操作方法。